引起人体出现鼻出血、便血、尿血及凝血时间延长的物质是
A. 瘦肉精
B. 克灭鼠
C. 敌敌畏
D. 巴比妥
E. 百草枯

正确答案：B。克灭鼠

解析：本题考查香豆素类中毒反应。香豆素类（比猫灵、克灭鼠（B对）、杀鼠醚）在误食后即表现恶心、呕吐、食欲缺乏、精神不振等，之后可出现鼻出血、齿龈出血、咯血、便血及凝血时间延长。